胞饮作用的特点是
A. 药物由高浓度区域向低浓度区域扩散
B. 需要能量
C. 借助于载体使非脂溶性药物由高浓度区域向低浓度区域扩散
D. 小于膜孔的药物分子通过膜孔进入细胞膜
E. 黏附于细胞膜上的某些药物随着细胞膜向内凹陷进入细胞内

正确答案：B、E。需要能量；黏附于细胞膜上的某些药物随着细胞膜向内凹陷进入细胞内

解析：本题考查药物的转运方式。胞饮作用为黏附于细胞膜上的某些药物随着细胞膜向内凹陷进入细胞内（E对），这种机制也需消耗能量（B对）；药物由高浓度区域向低浓度区域扩散（A错）属为被动转运；借助于载体使非脂溶性药物由高浓度区域向低浓度区域扩散（C错）为易化扩散；小于膜孔的药物分子通过膜孔进入细胞膜（D错）为膜孔转运。